属于运用五行相克关系阐释疾病传变的有
A. 肝病及肾
B. 心病及肾
C. 肺病及肾
D. 脾病及肾
E. 肝病及脾

正确答案：B、D、E。心病及肾；脾病及肾；肝病及脾

解析：本题考查的是五行学说的临床应用。属于运用五行相克关系解释疾病传变的有心病及肾（B对）、脾病及肾（D对）、肝病及脾（E对）。五行学说，不仅应用于说明在生理情况下脏腑间的相互联系，而且也可以说明在病变情况下脏腑间的相互影响。某脏有病可以传至他脏，他脏疾病也可以传至本脏，这种病变上的相互影响，称之为传变。中医药学可以应用事物属性的五行分类方法和生克乘侮的变化规律阐释疾病的传变。（1）相生关系的传变：包括“母病及子”与“子病及母”两个方面。母病及子，即母脏之病传及子脏。例如，肾精亏虚不能资助肝血而致的肝肾精血亏虚证，肾阴不足不能涵养肝木而致的肝肾阴虚、肝阳上亢证等。子病及母，即子脏之病传及母脏。例如，心血不足累及肝血亏虚而致的心肝血虚证，心火旺盛引动肝火而形成心肝火旺证等。（2）相克关系的传变：包括“相乘”和“相侮”两个方面。相乘，是相克太过致病。例如，由于肝气郁结或肝气上逆，影响脾胃的运化功能，即“木旺乘土”；或先有脾胃虚弱，不能耐受肝气的克伐，即“土虚木乘”，而致肝脾不调或肝胃不和证。相侮，是反向克制致病。例如，暴怒而致肝火亢盛，肺金不仅无力制约肝木，反遭肝火之反向克制，称为“木火刑金”；脾土虚衰不能制约肾水，出现全身水肿，称为“土虚水侮”。肝病及肾（A错）属于子病及母。肺病及肾（C错）属于母病及子。